治疗弱酸性药物中毒，碱化尿液可选用的药物
A. 碳酸氢钠
B. 氯化铵
C. 水杨酸
D. 乙酰唑胺
E. 枸橼酸钠

正确答案：A、E。碳酸氢钠；枸橼酸钠

解析：本题考查弱酸性药物中毒的解救。弱酸性药物中毒应使用碱性药物使血浆及尿液碱化，加速药物排泄。常用的碱性药物有碳酸氢钠（A对）、枸橼酸钠（E对）等。氯化铵（B错）、水杨酸（C错）、乙酰唑胺（D错）均为酸性药，可作为调节碱平衡药。